以下是正治法的是
A. 热者寒之
B. 热因热用
C. 寒者热之
D. 虚则补之
E. 实则泻之

正确答案：A、C、D、E。热者寒之；寒者热之；虚则补之；实则泻之

解析：本题考查的是正治。以下是正治法的是热者寒之（A对）、寒者热之（C对）、虚则补之（D对）与实则泻之（E对）。正治，又称逆治，是指采用方药的性质与疾病的证候性质相反的治疗法则。逆，即采用方药的性质与疾病的性质相反。正治，适用于临床表现与疾病证候本质相一致的病证。临床上大多数疾病的临床表现与疾病的证候性质是相符的，如寒病即见寒象、热病即见热象、虚病即见虚象、实病即见实象等，所以，正治是临床上最常用的一种治疗法则。常用的治法有寒者热之、热者寒之、虚则补之、实则泻之等。热因热用（B错）属于反治。反治，又称从治，是指顺从疾病证侯的外在假象而治的治疗法则。从，是指采用方药的性质与疾病证候的外在假象相同。反治，适用于临床表现与疾病证候本质不完全一致的病症。临床上某些疾病的临床表现（假象）与疾病的证候性质不完全相符，如寒病反见热象、热病反见寒象、虚病反见实象、实病反见虚象等。表面上，反治是顺从疾病证候的外在假象而治，究其实质，还是在“治病求本”指导下，针对疾病证候的本质而进行治疗。反治，主要包括热因热用、寒因寒用、塞因塞用、通因通用四种治法。